下橄榄核参与
A. 平衡调节
B. 体温调节
C. 生物钟调节
D. 情绪调节
E. 性调节

正确答案：A。平衡调节

解析：下橄榄核广泛接受脊髓全长的上行投射纤维和脑干感觉性中继核团的传入纤维，发出纤维与脊髓小脑后束等共同组成小脑下脚，进入小脑，参与平衡调节（A对）。体温的调节（B错）、生物钟调节（C错）与下丘脑有关。性调节（E错）与边缘系统有关。情绪调节（D错）与下丘脑、边缘系统有关。